男性，55岁，反复不规律上腹部胀痛3年，胃镜诊断为萎缩性胃炎。该患者如考虑为A型胃炎，正确的是
A. 壁细胞抗体阴性
B. 胃酸升高
C. 不出现厌食，体重下降
D. 不出现恶性贫血
E. 主要位于胃体部

正确答案：E。主要位于胃体部

解析：A型胃炎又称自身免疫性胃炎，主要位于胃底和胃体（E对）。患者血中抗壁细胞抗体阳性（A错），壁细胞减少，泌酸功能减弱，胃酸分泌明显降低（B错）；胃酸降低使消化功能减退，患者出现厌食、体重下降（C错）；患者体内抗内因子抗体阳性，内因子不能有效与维生素B₁₂结合，使体内维生素B₁₂缺乏，出现恶性贫血（D错）。